若用统计图直观的表示某城市在8年中肝炎的发病率随时间的变化情况，宜选择
A. 圆图
B. 直条图
C. 普通线图
D. 直方图
E. 散点图

正确答案：C。普通线图

解析：线图是用线段的升降来表示变量的连续变化情况，主要用于描述一个变量随另一个变量变化的趋势，通常用来表示一种统计指标随时间变化的的连续变化。要直观的表示某城市在8年中肝炎的发病率随时间的变化情况，最宜选择普通线图（C对）。圆图（A错）视一个圆的总面积为100%，用圆内扇形面积来表示全体中各部分所占的比例。直条图（B错）用等宽直条的长短来表示相互独立的统计指标数值大小和它们之间的对比关系。直方图（D错）用直条矩形面积代表各组频数，各矩形面积总和代表频数的总和。它主要用于表示连续变量频数分布情况。散点图（E错）用点的密集程度和变化趋势表示两指标之间的直线或曲线关系。